慢性支气管炎急性发作患者，伴发热。使用头孢他定二周后，体温曾一度降至正常，症状缓解。后再次出现发热，经检查，口腔粘膜有白色念珠菌感染，此时抗生素拟改用
A. 红霉素
B. 氯霉素
C. 青霉素
D. 两性霉素B
E. 环丙沙星

正确答案：D。两性霉素B

解析：目前患者出现发热的原因为白色念珠菌感染，白色念珠菌是真菌，而两性霉素B（D对）是广谱抗真菌药，可有效治疗白色念珠菌引起的口腔黏膜感染。红霉素（A错）常用于治疗耐青霉素的金黄色葡萄球菌感染和对青霉素过敏者。氯霉素（B错）主要用于耐药菌诱发的严重感染。青霉素（C错）治疗敏感的G⁺球菌和杆菌、G⁻球菌及螺旋体所致感染的首选药。环丙沙星（E错）主要用于对其他抗菌药产生耐药的革兰氏阴性杆菌所致的呼吸道、泌尿生殖道、消化道、骨与关节和皮肤软组织感染。